通过对疾病状况分布与影响因素之间内在关系的深入研究为
A. 描述流行病学
B. 理论流行病学
C. 实验流行病学
D. 分析流行病学
E. 病例对照研究

正确答案：B。理论流行病学

解析：理论流行病学：是通过对疾病或健康状况的分布与影响因素之间内在关系的深入研究，建立数学模型以描述疾病流行规律、预测疾病流行趋势、检验疾病防治效果。掌握“流行病学概论”知识点。